支气管肺泡呼吸音分布于
A. 左锁骨上窝
B. 右锁骨上窝
C. 胸骨角周围
D. 胸骨上窝
E. 肩胛间区

正确答案：C。胸骨角周围

解析：支气管肺泡呼吸音为兼有支气管呼吸音和肺泡呼吸音特点的混合性呼吸音，正常人于胸骨两侧第1、2肋间隙（C对），肩胛间区第3、4胸椎水平（E错）以及肺尖前后部可听及支气管肺泡呼吸音。左锁骨上窝（A错）、右锁骨上窝（B错）为肺部听诊的起始部位，可闻及气管呼吸音；胸骨上窝（D错）可闻及支气管呼吸音。